一侧面神经核下瘫
A. 皱额时,患侧额纹正常
B. 病灶对侧不能闭眼,口角偏向病灶对侧
C. 病灶同侧不能闭眼,口角偏向病灶同侧
D. 病灶对侧不能闭眼,口角偏向病灶同侧
E. 病灶同侧不能闭眼,口角偏向病灶对侧

正确答案：E。病灶同侧不能闭眼,口角偏向病灶对侧

解析：面神经核支配面肌活动，其上部接受双侧皮质核束支配，支配同侧眼裂以上的表情肌；下部仅接受对侧皮质核束支配，支配同侧眼裂以下的表情肌。一侧面神经核下瘫时，支配同侧眼裂上下的表情肌的面神经纤维均中断，因而出现同侧面肌瘫痪，可表现为病灶同侧不能闭眼, 口角偏向病灶对侧（E对）。皱额时, 患侧额纹正常（A错）可见于面神经核上瘫时，因面神经核上部受双侧皮质核束支配，一侧皮质核束受损后面神经核上部仍可接受对侧皮质核束下达的指令。